流浸膏含醇量每100ml至少为
A. 5g
B. 15g
C. 20ml
D. 60g
E. 85g

正确答案：C。20ml

解析：本题考查的是浸膏剂的分类。流浸膏含醇量每100ml至少为20ml（C对）。流浸膏剂、浸膏剂系指饮片用适宜的溶剂提取，蒸去部分或全部溶剂，调整至规定浓度而制成的制剂。根据溶剂不同，流浸膏剂与浸膏剂有以水为溶剂制备而成和以乙醇为溶剂制备而成之分，其中大多以不同浓度的乙醇为溶剂，以水为溶剂者较少。以水为溶剂的流浸膏剂中可酌加20%～25%的乙醇为防腐剂。